临床上检查牙本质过敏部位常用的方法为
A. 热诊
B. 冷诊
C. 探诊
D. 叩诊
E. 酸甜试验

正确答案：C。探诊

解析：探诊是牙本质过敏最可靠的诊断方法，可用尖锐的探针在牙面上滑动，可找到1个或数个过敏区。掌握“牙本质敏感症”知识点。